下列哪项不属足太阴经的主治范围
A. 妇科病
B. 口舌病
C. 前阴病
D. 肾脏病
E. 脾胃病

正确答案：D。肾脏病

解析：足太阴脾经主治脾胃病（E对）、妇科病（A对）、前阴病（C对）和经脉循行部位的其他病证，足太阴脾经连舌本散舌下，故可以治疗口舌病（B对）（D错，为本题正确答案）。